性成熟期
A. 卵巢可以排卵
B. 月经不规律
C. 是一生中生育活动的鼎盛时期
D. 不易患妇科疾病
E. 易患妇女的常见病，如炎症、功能失调、肿瘤等

正确答案：C。是一生中生育活动的鼎盛时期

解析：本题考查性成熟期的相关内容。性成熟期是一生中生育活动的鼎盛时期（C对ABDE错）。